肾上腺素不会引起以下哪种情况
A. 心悸
B. 头痛
C. 紧张
D. 呕吐
E. 颤抖

正确答案：D。呕吐

解析：由于肾上腺素可引起心悸、头痛、紧张、恐惧、颤抖、失眠，如用量过大，或注射时误入血管，可引起心血管功能障碍，也可因血压升高而发生脑出血，或因心脏过度兴奋引起心律失常，甚至心室纤颤等不良反应。掌握“颌面部常用局部麻醉药物”知识点。